分布于胸腹第一侧线的经脉是
A. 足太阴脾经
B. 足少阴肾经
C. 足少阳胆经
D. 足阳明胃经
E. 足厥阴肝经

正确答案：B。足少阴肾经

解析：该题考查十二经脉在躯干部的分布规律。循行与腹胸面的经脉，正中线为任脉，自内向外依次为足少阴肾经（距正中线在腹部为0.5寸，在胸部为2寸）（B对）、足阳明胃经（距正中线在胸部为4寸，经过乳头，在腹部为2寸）（C错）、足太阴脾经（距正中线在腹部为4寸，在胸部为6寸）（A错）和足厥阴肝经（在胁肋部和胸外侧部）（E错）。足少阳胆经下经腋、侧胸、季胁部（C错）。记忆：在胸腹部由内向外依次是，任肾胃脾肝，趣记，人身为皮干。